下列除哪项外，均是玉门的别称
A. 胞门
B. 阴门
C. 产门
D. 子门
E. 龙门

正确答案：D。子门

解析：玉门即阴道口。古代根据婚嫁、产与未产的不同，对阴道口又冠以不同的命名，已产属胞门（A对）。廷孔又称为产门，而妇人产门，其处子曰阴门。廷孔是玉门最早的名称，故（BC对）。子门为子宫颈口（D错，为本题正确答案）。古人根据产与未产将未产称为龙门（E对）。